符合早期胃癌诊断条件的是
A. 肿瘤仅限于胃窦
B. 癌未累及肌层
C. 肿瘤直径小于0.5cm
D. 黏膜皱襞消失
E. 肿瘤直径小于1cm

正确答案：B。癌未累及肌层

解析：早期胃癌指癌组织浸润仅限于黏膜层或黏膜下层，而无论有无淋巴结转移，空腔脏器由内到外分别为黏膜层，黏膜下层，肌层，浆膜层，未累及肌层即仅限于黏膜层或黏膜下层（B对）。早期胃癌中，若直径小于0.5cm者称微小癌（C错），直径0.6~1.0cm者称小胃癌（E错）。胃癌好发于胃窦小弯侧，但并不是早期胃癌诊断条件（A错）。胃黏膜由正常的橘红色变为灰色或灰绿色，黏膜层变薄，皱襞变浅，甚至消失，黏膜下血管透见，表面呈细颗粒状，偶有出血和糜烂为慢性萎缩性胃炎的病理变化（D错）。